血府逐瘀汤适用于治疗糖尿病的证型是
A. 痰瘀互结
B. 气阴两虚
C. 阴虚燥热
D. 阴阳两虚
E. 脉络瘀阻

正确答案：E。脉络瘀阻

解析：血府逐瘀汤可活血通络，故可用于治疗糖尿病脉络瘀阻证（E对）。痰瘀互结（A错）证治法为活血化瘀祛痰，方药用平胃散合桃红四物汤加减；气阴两虚（B错）证治法为益气健脾，生津止渴，方药选用七味白术散加减；阴虚燥热（C错）证应滋阴固肾，方药用六味地黄丸加减；阴阳两虚（D错）证应滋阴温阳，补肾固摄，方药用金匮肾气丸加减。